预防麻疹疫苗初种年龄
A. 生后2～3天到2个月之内
B. 2个月以上
C. 8个月以上易感儿
D. 3个月以上小儿
E. 1岁以上

正确答案：C。8个月以上易感儿

解析：本题考查预防麻疹疫苗的初种年龄。麻疹抗体虽可胎传，但在婴儿出生后8月龄左右时来自母体的麻疹抗体基本消耗殆尽，故规定婴儿8月龄时（C对ABDE错）开始接种麻疹疫苗。